胆固醇体内代谢的主要去路是在肝中转化为
A. 乙酰CoA
B. NADPH
C. 维生素D
D. 类固醉
E. 胆汁酸

正确答案：E。胆汁酸